医学伦理学基本规范的形成在本质上是
A. 客观因素与主观因素的统一
B. 全人类性与阶级性的统一
C. 稳定性与变动性的统一
D. 抽象性与概括性的统一
E. 相对性与绝对性的统一

正确答案：A。客观因素与主观因素的统一

解析：医学道德规范的形成在本质上是客观因素与主观因素的统一。掌握“医学伦理学的基本规范”知识点。